牙髓内的神经在受到外界刺激后，其反应均表现为
A. 无感觉
B. 热感
C. 冷感
D. 痛感
E. 麻木感

正确答案：D。痛感

解析：牙髓内的神经在受到外界刺激后，常反应为痛觉，而不能区分冷、热、压力及化学变化等不同感受，这可能是因为牙髓缺乏对这些刺激的感受器。掌握“牙髓”知识点。